先用2%醋酸冲洗，继用清水冲洗，再用3%硼酸溶液湿敷，或用5%～10%硼酸软膏外涂
A. 硫酸灼伤
B. 氢氧化钠灼伤
C. 氧化钙灼伤
D. 苯酚灼伤
E. 沥青灼伤

正确答案：B。氢氧化钠灼伤